属于利尿降压药的是
A. 咖啡因
B. 氢氯噻嗪
C. A和B均是
D. A和B均不是

正确答案：B。氢氯噻嗪

解析：本题考查利尿降压药。属于利尿降压药的是氢氯噻嗪（B对）。氢氯噻嗪为中效能利尿药，是一类口服利尿药和降压药，其药理作用包括利尿作用、抗利尿作用和降压作用（D错）。咖啡因（AC错）为中枢兴奋药，无利尿降压作用。